为次黄嘌呤类似物的药物是
A. 8氮杂鸟嘌呤
B. 甲氨蝶呤
C. 阿糖胞苷
D. 5-氟尿嘧啶
E. 别嘌呤醇

正确答案：E。别嘌呤醇